洋金花中含有的生物碱有
A. 东莨菪碱
B. N-去甲莨菪碱
C. 莨菪碱
D. 黄连碱
E. 药根碱

正确答案：A、B、C。东莨菪碱；N-去甲莨菪碱；莨菪碱

解析：本题考查的是洋金花中主要生物碱。洋金花中含有的生物碱有东莨菪碱（A对）、N-去甲莨菪碱（B对）与莨菪碱（C对）。洋金花主要化学成分为莨菪烷类生物碱，由莨菪醇类和芳香族有机酸结合生成的一元酯类化合物。主要有莨菪碱（阿托品）、山莨菪碱、东莨菪碱、樟柳碱和N-去甲莨菪碱。《中国药典》以东莨菪碱为指标成分进行含量测定，要求东莨菪碱不得少于0.15%。黄连碱（D错）与药根碱（E错）为黄连的主要化学成分。黄连的有效成分主要是生物碱，已经分离出来的生物碱有小檗碱（含量最高）、巴马汀、黄连碱、甲基黄连碱、药根碱和木兰碱（属于阿朴菲型）等；大多属苄基异喹啉类衍生物，季铵型生物碱。《中国药典》以小檗碱为指标成分进行含量测定。以盐酸小檗碱计，要求味连含小檗碱不得少于5.5%，表小檗碱不得少于0.80%，黄连碱不得少于1.6%，巴马汀不得少于1.5%；要求雅连含小檗碱不得少于4.5%；要求云连含小檗碱不得少于7.0%。